与红外分光光度法有关的术语有
A. 波数
B. 校正因子
C. 分离度
D. 伸缩振动
E. 指纹区

正确答案：A、D、E。波数；伸缩振动；指纹区